肺换气的驱动力是
A. 呼吸膜两侧气体分压梯度
B. 呼吸膜气体交换面积
C. 呼吸膜通透性
D. 气体分子与血红蛋白亲和力
E. 气体分子溶解度

正确答案：A。呼吸膜两侧气体分压梯度

解析：混合静脉血流经肺毛细血管时，血液PO2为40mmHg，比肺泡气102mmHg的PO2低，O2就在分压差的作用下由肺泡气向血液净扩散，使血液PO2逐渐上升，最后接近肺泡气的PO2（A对）（P166）。呼吸膜气体交换面积，呼吸膜通透性，气体分子与血红蛋白亲和力，气体分子溶解度，均是影响肺换气的因素，但并不是肺换机的驱动力，这一点要注意区别（BCDE错）。